分子中含有2，6-二甲基苯胺结构片段的局部麻醉药有
A. 盐酸利多卡因
B. 盐酸丁卡因
C. 盐酸布比卡因
D. 盐酸普鲁卡因
E. 可卡因

正确答案：A、C。盐酸利多卡因；盐酸布比卡因